六腑“以降为顺，以通为用”的理论基础是
A. 六腑的形体特点为空腔器官
B. 六腑都是接受水饮食物的受盛器官
C. 六腑都不是贮藏精气的器官
D. 六腑既是受盛水谷又是传化糟粕的器官
E. 以上都不对

正确答案：D。六腑既是受盛水谷又是传化糟粕的器官

解析：六腑，是胆、胃、小肠、大肠、膀胱、三焦的总称。它们的生理特点是受盛和传化水谷，因而其气具有通降下行的特性（D对）。